昼夜分阴阳，则上午为
A. 阴中之阳
B. 阳中之阳
C. 阳中之阴
D. 阴中之阴
E. 阴中之至阴

正确答案：B。阳中之阳

解析：阴阳是事物的普遍属性，昼夜分阴阳属于阴阳属性的相对性。就白昼与黑夜而言，白昼为阳，黑夜为阴。阴阳又具有无限可分性，故白昼与黑夜还可以再分阴阳。白天阳盛，上午太阳上升，温度逐渐升高，属于阳中之阳（B对），下午太阳西下，温度逐渐降低，属于阳中之阴（C错）；黑夜阴盛，前半夜夜幕降临，黑暗加重，属于阴中之阴（D错），后半夜星夜渐退，旭日将升，属于阴中之阳（A错）。阴中之至阴属于阴阳学说在中医学中的应用，五脏分阴阳，脾属土，居中焦，为阴中之至阴（E错）。